下列关于我国伤害的流行病学特征正确的有
A. 城市伤害死亡的原因依次为：非故意跌落、交通事故、自杀
B. 农村伤害死亡的原因依次为：溺水、自杀、交通事故
C. 1～17岁年龄段的首位伤害死因是溺水
D. 60岁及以上老年人群的首位伤害死因是自杀
E. 伤害死亡的时间变化趋势主要表现在交通事故的持续下降

正确答案：C。1～17岁年龄段的首位伤害死因是溺水

解析：本题考查我国伤害的流行病学特征。城市人群伤害死亡的原因依次为：交通事故、非故意跌落、自杀、其他非故意事故、溺水、非故意中毒等（A错）；农村人群伤害死亡的主要原因依次为：交通事故、非故意跌落、自杀、溺水、其他非故意事故、非故意中毒等（B错）。不同年龄阶段，主要的伤害致死原因各异。对于＜l 岁的婴儿，非故意的机械性窒息高居首位；1～14岁年龄段，溺水是该年龄段死亡的首因（C对）；15～59岁劳动力人口是伤害死亡的高发人群；交通事故死亡在该年龄组男性的总死亡中占1/3；而自杀则是15～34岁女性的首位伤害死因；对于60岁及以上的老年人群，跌倒是老年人最常见的伤害类型（D错）。伤害死亡的时间变化趋势主要表现在自杀率的持续下降（E错）。